反佐药的含义是
A. 用以消除成减缓君臣药的毒性与烈性的药物
B. 据病情需要，用与君药性味相反而又能在治疗中起相成作用的药物
C. 据病情需要，用与君药性味相同而起加强作用的药物
D. 协助君臣药以加强治疗作用的药物
E. 直接治疗次要的症状的药物

正确答案：B。据病情需要，用与君药性味相反而又能在治疗中起相成作用的药物

解析：佐药包括佐助药、佐制药和反佐药三种。其中，佐助药，即协助君、臣药以加强治疗作用（D错），或直接治疗次要兼证的药物（E错）；佐制药，即制约君、臣药的峻烈之性，或减轻或消除君、臣药毒性的药物（A错）；反佐药，即根据某些病证之需，配伍少量与君药性味或作用相反而又能在治疗中起相成作用的药物（B对C错），以防止药病格拒，一般用量较轻。